属于特异性感染的是
A. 疖
B. 痈
C. 丹毒
D. 急性化脓性腱鞘炎
E. 气性坏疽

正确答案：E。气性坏疽

解析：特异性感染是指由结核杆菌、破伤风梭菌、产气荚膜梭菌、炭疽杆菌、白念珠菌等病原体所引起的感染，不同于一般性感染的病菌，可以引起较为独特的病变，其在病程演变及治疗处置等方面与一般感染不同。气性坏疽（E对）是由产气荚膜梭菌引起的特异性感染疾病。非特异性感染（P108）又称化脓性感染或一般性感染，常见致病菌有葡萄球菌、链球菌、大肠埃希菌等，常见疾病有疖（多由金黄色葡萄球菌引起）（A错）、痈（多由金黄色葡萄球菌引起）（B错）、丹毒（由乙型溶血性链球菌引起）（C错）等。急性化脓性腱鞘炎（D错）是主要由金黄色葡萄球菌引起的，属非特异性感染。